美国一女性患者，患有严重的脑综合征、压疮、心脏病、糖尿病等，对环境没有感觉，只有原始的脑功能，有自主呼吸，没有认识、行为能力，且无改善的希望，住院不久即插入鼻饲管以维持生命。她的监护人要求取走鼻饲管，被主管医师拒绝，监护人向法院起诉要求强迫取走，法院同意并下令取走：但受理上诉的法院否定了这个决定，认为中止喂饲就是杀人。3年后，女患者死亡，她的鼻饲管仍保留着。从医学伦理学角度说，此案例反映出的突出问题应除外
A. 临床医学决策同时也是伦理判断
B. 医学上可能做的，不一定在伦理上是应该做的
C. 市场经济对医学实践的正、负效应并存
D. 生命神圣论与生命质量论的冲突
E. 传统医德规范与现代医德观念的矛盾

正确答案：C。市场经济对医学实践的正、负效应并存